女，35岁。反复关节痛2年，予双氯芬酸治疗后症状有所缓解。1年前患者出现面部水肿，查尿蛋白（+++），诊断为慢性肾炎，予静脉注射白蛋白、利尿等治疗后症状好转。近2个月出现牙龈出血、皮肤瘀点，月经量增加。血常规：Hb93g/L，WBC6.8×10⁹/L，N0.85，Plt50×10⁹/L。ANA（+）。最可能的诊断是
A. Evans综合征
B. 系统性红斑狼疮
C. 过敏性紫癜
D. 再生障碍性贫血
E. 急性白血病

正确答案：B。系统性红斑狼疮

解析：患者多系统受累：关节痛，肾损害，Hb下降、血小板减少，且ANA（+），综合患者情况，最可能的诊断是系统性红斑狼疮（B对）。